实邪结聚，阻滞经络，气血不能外达，其病机是
A. 实中夹虚
B. 虚中夹实
C. 真虚假实
D. 真实假虚
E. 上实下虚

正确答案：D。真实假虚

解析：本题考查的是邪正盛衰的病机。实邪结聚，阻滞经络，气血不能外达，其病机是真实假虚（D对）。在特殊情况下，病变可出现本质与表现不一致的虚实真假变化，这对于全面认识疾病的发展及转化具有重要意义。1.虚实变化：在疾病的发展变化过程中，正气和邪气这两种力量不是固定不变的，而是正邪双方在其斗争的过程中，在力量对比上发生着消长盛衰的变化。（1）实：实，即邪气亢盛，是以邪气盛为矛盾主要方面的病机变化。（2）虚：虚，即正气不足，是以正气虚损为矛盾主要方面的病机变化。2.虚实错杂：（1）实中夹虚（A错）：实中夹虚，是指以邪实为主，兼见正气虚损的病机变化。例如，外感热病发展过程中，由于邪热炽盛，消灼津液而形成的实热伤津、气阴两伤病证，出现高热、烦渴欲饮、尿少便干等表现，就属于实中夹虚的病机变化。（2）虚中夹实（B错）：虚中夹实，是指以正虚为主，兼夹邪实的病机变化。例如，脾阳不振，运化无权之水肿病，即属此类。这是由于脾失健运，气不化水，水湿停聚，泛溢肌肤所致。因为水湿之邪滞留于体内，故称之为实，但其邪实乃由脾虚不运所致，故其病变变化仍以虚为主，而邪实则居其次，属于虚中夹实的病证。3.虚实转化：（1）由实转虚：由实转虚，是指因疾病失治或治疗不当，以致病邪久留，损伤人体正气，导致疾病由实转化为虚。例如，实热证大量耗伤阴液，可转化为虚热证。（2）因虚致实：因虚致实，是指因正气不足，无力驱邪外出，或正虚而内生水湿、痰饮、瘀血等病变产物的凝结阻滞，导致疾病由虚转化致实。例如，肺肾两虚的哮证，肺卫不固，复感风寒，哮喘复发，而见寒邪束表，痰涎壅肺证。4.虚实真假：（1）真实假虚：又称“大实有羸状”，是指病机的本质为“实”，但表现出“虚”的临床假象的病机变化。一般是由于邪气亢盛，结聚体内，阻滞经络，气血不能外达所致。例如，热结肠胃，一方面出现腹痛硬满拒按、大便秘结、潮热、谵语等实热症状，同时因阳气被遏，不能外达，可见面色苍白、四肢逆冷、精神委顿等状似虚寒的假象。（2）真虚假实（C错）：又称“至虚有盛候”，是指病机的本质为“虚”，但表现出“实”的临床假象的病机变化。一般是由于正气虚弱，脏腑经络气血不足，功能减退，气化无力所致。例如，脾气虚弱，运化无力，可见脘腹胀满、疼痛等假实征象。又如，老年或大病久病，因气虚推动无力而出现的便秘等。分析病机的虚或实，必须透过现象看本质，才能不被假象所迷惑，真正把握住疾病的虚实变化。上实下虚（E错），2022年考试指南未明确说明。